属治疗流行性脑脊髓膜炎的首选药物之一的是
A. 磺胺甲噁唑
B. 磺胺嘧啶
C. 磺胺异噁唑
D. 甲氧苄啶
E. 磺胺米隆

正确答案：B。磺胺嘧啶

解析：磺胺甲噁唑、磺胺嘧啶、磺胺异噁唑、磺胺米隆均属于黄安类抗菌药，可与PABA竞争二氢叶酸合成酶，妨碍二氢叶酸的合成，进而影响核酸的合成，从而抑制细菌的生长繁殖。磺胺嘧啶（B对）血浆蛋白结合率较低，脂溶性较高，易通过血脑屏障，为预防和治疗流行性脑脊髓膜炎的首选药物之一。磺胺甲噁唑（A错）进入脑脊液的浓度低于磺胺嘧啶，临床常用于泌尿系统感染和预防流行性脑脊髓膜炎。磺胺异恶唑（C错）为短效的磺胺类药物，乙酰化率低，不易在尿中形成结晶，高浓度原型经尿排出，临床主要用于泌尿道感染。甲氧苄啶（D错）可抑制二氢二酸还原酶，阻碍四氢叶酸的合成，和与磺胺类合用双重阻断细菌叶酸代谢，用于敏感菌所致的感染。磺胺米隆（E错）属于外用的磺胺类抗菌药，渗透性好，抗菌活性不受坏死组织合脓液的影响，抗菌谱广，临床主要用于烧伤和大面积创伤后的感染。